SnF2用于抑制龈下菌斑并能延缓牙周再感染的浓度为
A. 0.0005
B. 0.0012
C. 0.002
D. 0.0164
E. 0.025

正确答案：D。0.0164

解析：氟化亚锡是活性较高的抗菌剂，锡离子进入细菌细胞并滞留，从而影响细胞的生长和代谢，因此能抑制菌斑形成。用1.64%的SnF2做龈下冲洗，能抑制龈下菌斑并能延缓牙周再感染。掌握“菌斑控制及提高宿主抵抗力”知识点。